女，54岁，手指有弹响指，最有可能的疾病是
A. 痛风
B. 风湿热
C. 狭窄性腱鞘炎
D. 骨关节炎
E. 类风湿关节炎

正确答案：C。狭窄性腱鞘炎

解析：患者老年女性，手指有弹响指（弹响指和弹响拇是狭窄性腱鞘炎的特征性表现），提示狭窄性腱鞘炎（C对），严重者患指屈曲，不敢活动。随病情延长逐渐出现弹响伴明显疼痛。痛风（A错）（九版内科学P861）多在午夜或清晨突然起病，关节剧痛，呈撕裂样、刀割样或咬噬样，难以忍受；数小时内出现受累关节的红、肿、热、痛和功能障碍；单侧第1跖趾关节最常见。骨性关节炎（D错）（P761）好发于负重较大的关节，如膝关节、髋关节等。风湿性关节炎（B错）好发于膝关节、踝关节、肩关节、腕关节等大关节，呈游走性，常反复发作。类风湿性关节炎（E错）（九版内科学P808）主要表现为晨僵、关节痛与压痛、关节肿及关节畸形，没有弹响指。